某医师治疗心血管病常用的成药有通心络胶囊与诺迪康胶囊，二者均具的功能有
A. 益气
B. 活血
C. 养血
D. 豁痰
E. 止痛

正确答案：A、B、E。益气；活血；止痛

解析：本题考查的是通心络胶囊与诺迪康胶囊的功能。某医师治疗心血管病常用的成药有通心络胶囊与诺迪康胶囊，二者均具的功能有益气（A对）、活血（B对）与止痛（E对）。通心络胶囊：【功能】益气活血，通络止痛。诺迪康胶囊：【功能】益气活血，通脉止痛。人参再造丸：【功能】益气养血（C错），祛风化痰，活血通络。石菖蒲：【功效】开窍宁神，化湿和胃。石菖蒲辛苦而温，功能开窍醒神、化湿豁痰（D错）。